女，48岁。近一个月感口渴饮水量增至每天2000毫升。身高156厘米、体重71公斤。空腹血糖180mg/dl（10.0mmol/L）餐后血糖252mg/dl（14.0mmol/L）。系初次发现血糖高，过去无糖尿病史。4年后该患者被发现有浸润型肺结核，降血糖治疗宜
A. 原降血糖药增加剂量
B. 改用降血糖作用更强的口服降血糖药
C. 增加一种口服降血糖药
D. 双胍类磺脲类α-葡萄糖苷酶抑制剂联合使用
E. 胰岛素治疗

正确答案：E。胰岛素治疗

解析：中年女性患者，出现口渴、多饮（糖尿病典型症状），空腹血糖＞7.0 mmol/L，餐后血糖＞11.1 mmol/L，体重指数为29.2（体重指数=体重（kg）/身高²（m²），正常值为18.5～24.9，＞29则提示肥胖），既往无糖尿病史，考虑诊断为2型糖尿病。糖尿病易并发各种感染，糖尿病患者并发感染后应尽快将血糖控制在理想水平，以免感染扩散难以控制。本例患者并发浸润性肺结核应改用胰岛素（E对）控制血糖，使血糖尽快达标。原降血糖药增加剂量（A错）、改用降血糖作用更强的口服降血糖药（B错）、增加一种口服降血糖药（C错）及双胍类、磺脲类、α-葡萄糖苷酶抑制剂联合使用（D错）均不如胰岛素控制血糖效果好且稳定。